苯二氮䓬类药物使用必须通过增加用量才能获得原有剂量所能达到的效果，这种现象称为
A. 耐受性
B. 依赖性
C. 戒断性
D. 灵敏性
E. 特异性IgM抗体

正确答案：A。耐受性

解析：必须通过增加用量才能获得原有剂量所能达到的效果的现象称为耐受性（A对），耐受性（P36）为机体在连续多次用药后对药物的反应性降低，增加剂量可恢复反应，停药后耐受性可消失。依赖性（P36）（B错）指长期应用某药物后，机体对这种药物产生生理性或精神性的依赖和需求。戒断性（C错）即停药综合征（P37），患者在长期反复用药后突然停药可发生停药症状，如高血压患者长期应用β肾上腺受体阻断药后，如果突然停药，血压和心率反跳性升高，症状加重。灵敏性（D错）是反应药物的敏感程度。特异性IgM抗体（E错）与本题无关。